有关3/4冠牙体预备的正确叙述是
A. 临床牙冠长，倒凹大者，邻面冠边缘应止于龈缘
B. 上前牙切斜面由舌侧斜向唇侧
C. 在切端斜面舌1/3处，做一顶角90°的沟
D. 舌轴壁的倒凹不必消除，可以舌隆突为界分两段预备
E. 邻沟与邻面的线角清晰，有棱角

正确答案：C。在切端斜面舌1/3处，做一顶角90°的沟

解析：本题考查3/4冠牙体预备。前牙3/4冠牙体预备时，用倒锥形车针或火焰形车针在切缘预备好的切端斜面舌1/3处上，做出一平行于切嵴的0.5mm深、1mm宽的90°切嵴沟（C对），沟的两端与邻面沟的开口相连。3/4冠是覆盖于部分牙冠表面的固定修复体，因是部分冠，牙体预备较为复杂。临床牙冠长，倒凹大者，邻面冠边缘可在龈缘以上（A错），冠覆盖区内应无倒凹；若止于龈缘因倒凹大会去除大量牙体组织，大幅减少牙体抗力激惹牙髓。上前牙切缘预备时，只预备切缘的舌侧部分（B错），用轮状车针均匀磨除0.7mm成一小平面，尖牙做成近远中两个小平面，尽可能的少暴露金属。舌面预备时，舌轴壁的倒凹一定要磨除（D错），形成与牙长轴一致的轴壁，边缘终止在预定的位置，以保证修复体就位，密合。邻沟与邻面的线角应清晰圆顿而无明显棱角（E错），因棱角处修复体有应力集中易造成修复体折断。